下列与肯氏第二类缺失义齿的特点及设计要点基本相同的是
A. 肯氏第一类
B. 肯氏第三类
C. 肯氏第四类
D. 肯氏第五类
E. 肯氏第六类

正确答案：A。肯氏第一类

解析：Kennedy第二类的设计要点：第二类缺失义齿的特点及设计要点均与第一类基本相同。掌握“局部义齿的设计”知识点。